先天性甲状腺功能减退症的新生儿筛查下列哪项是错误的
A. 生后2～3天的新生儿
B. 应用干血滴纸片
C. 测TSH的浓度
D. TSH大于20mU/L即可确诊
E. 该方法简便实用

正确答案：D。TSH大于20mU/L即可确诊

解析：先天性甲状腺功能减退症是由于甲状腺激素合成不足或其受体缺陷所致的一种疾病，由于其发病率较高，因此早期诊断、早期治疗至关重要。其中新生儿筛查是指目前多采用出生后2～3天（A对）的新生儿干血滴纸片（B对）检测TSH浓度（C对）作为初筛，结果大于15～20mU/L（D错，为本题正确答案）时，再检测血清T4、TSH确诊，该法采集标本简便（E对），故为患儿早期诊断、避免神经精神发育严重缺陷、减轻家庭和社会负担的重要防治措施。